由于竞争性占据酸性转运系统，阻碍青霉素肾小管分泌，进而延长青霉素作用的药是
A. 阿米卡星
B. 克拉维酸
C. 头孢哌酮
D. 丙磺舒
E. 丙戊酸钠

正确答案：D。丙磺舒

解析：本题考查药物的相互作用。由于竞争性占据酸性转运系统，阻碍青霉素肾小管分泌，进而延长青霉素作用的药是丙磺舒（D对）。丙磺舒与青霉素均为酸性药，同用时可产生竞争性抑制，延缓青霉素的排泄，延长作用时间。